男，19岁。发热、咳嗽伴左胸痛5天。既往体健。查体：T39.5℃，左下肺叩诊呈浊音，可闻及支气管呼吸音。该患者最可能感染的病原体是
A. 结核分枝杆菌
B. 肺炎链球菌
C. 金黄色葡萄球菌
D. 肺炎支原体
E. 铜绿假单胞菌

正确答案：B。肺炎链球菌

解析：男，19岁（大叶性肺炎好发于青年人），发热、咳嗽伴左胸痛5天（符合大叶性肺炎常见临床表现），既往体健，查体：T39.5℃（提示高热，正常体温36.3-37.2℃），左下肺叩诊呈浊音，可闻及支气管呼吸音（提示肺实变，符合大叶性肺炎体征），综上所述该患者最可能的诊断为：大叶性肺炎，最可能感染的病原体是肺炎链球菌（B对）。结核分枝杆菌（A错）感染一般是低热，无胸痛，肺实变等症状和体征。金黄色葡萄球菌（C错）是有感染高危因素患者的常见病原体，其感染多有早期空洞，脓胸。肺炎支原体（D错）感染起病缓，有乏力、肌痛，头痛。铜绿假单胞菌（E错）是有感染高危因素患者的常见病原体，感染后毒血症状明显，有黄绿色脓痰，有弥漫性支气管炎，早期有肺脓肿。